健康危险因素评价是研究危险因素与什么疾病发病及死亡之间数量依存关系及其规律性的一种技术方法
A. 传染病
B. 寄生虫
C. 营养不良
D. 慢性病
E. 急性病

正确答案：D。慢性病